某儿科医生使用卡钳测量皮褶厚度，用于评价儿童青少年近期的营养状况。以下对于卡钳测量特点说法错误的一项是
A. 简单而经济
B. 测量结果与X线片测量法相关度不高
C. 对人体无放射性伤害
D. 操作者熟练程度、技术差异，结果容易产生测量误差
E. 被测者的皮褶厚度不同，会对技术差异的产生有影响

正确答案：B。测量结果与X线片测量法相关度不高